精索静脉曲张，左侧多于右侧的主要原因不是
A. 左侧呈直角注入左肾静脉
B. 乙状结肠压迫
C. 人肾静脉处瓣膜发育不全
D. 静脉壁的平滑肌薄弱
E. 左肾下垂

正确答案：E。左肾下垂

解析：精索静脉曲张是指精索内蔓状静脉丛的异常伸长、扩张和迂曲，以左侧多见，其主要原因为：①左侧精索内静脉呈直角注入左肾静脉（A对），左肾静脉通过主动脉和肠系膜上动脉之间，使左侧回流阻力增大；左精索内静脉下段位于乙状结肠后面，使左精索内静脉易受乙状结肠压迫（B对），左侧静脉回流受阻；②左精索内静脉注入左肾静脉的入口处有瓣膜防止逆流，如静脉瓣发育不全（C对），静脉壁丛的平滑肌或弹力纤维薄弱（D对），则可导致精索静脉曲张。左肾下垂（E错，为本题正确答案）不会导致精索静脉曲张。